患者，女，64岁，患2型糖尿病、高脂血症，给予二甲双胍肠溶片0.5g，tid，po、瑞格列奈片1mg，tid，po、阿托伐他汀钙片20mg，tid，po等药物治疗。该患者用药一段时间后再次就诊，复查肾功能提示：肌酐清除率29ml/min，需要调整治疗方案。合理的治疗药物调整方案是
A. 停用二甲双胍肠溶片
B. 停用瑞格列奈片
C. 停用阿托伐他汀钙片
D. 停用瑞格列奈片和阿托伐他汀钙片
E. 停用二甲双胍肠溶片和瑞格列奈片

正确答案：A。停用二甲双胍肠溶片

解析：本题考查降糖药的不良反应。合理的治疗药物调整方案是停用二甲双胍肠溶片（A对）。内生肌酐清除率正常值的参考范围是：成人80～120ml/min；该患者肌酐清除率为29ml/min，严重肾功能不全。二甲双胍对肾功能不全患者、肾功能减退患者慎用。